睾丸支持细胞的功能不包括
A. 支持、营养和保护精子
B. 吞噬残余胞质
C. 分泌雄激素结合蛋白
D. 参与血—睾屏障的组成
E. 分泌少量雌激素

正确答案：E。分泌少量雌激素

解析：支持、营养和保护精子（A对）、吞噬残余胞质（B对）、分泌雄激素结合蛋白（C对）、参与血—睾屏障的组成（D对）均为睾丸支持细胞的功能。睾丸支持细胞表达的芳香化酶可将间质细胞产生的睾酮转化为雌激素，但不能直接分泌（E错，为本题正确答案）雌激素。